患者，男性，35岁，牙龈刷牙出血4年余，进食时碰触易出血，含漱后可止住。检查：牙龈红肿。探诊深度3mm，X线片：未见牙槽嵴顶吸收。此患者最可能的诊断是
A. 青春期龈炎
B. 慢性牙周炎
C. 慢性龈缘炎
D. 坏死性龈炎
E. 侵袭性牙周炎

正确答案：C。慢性龈缘炎

解析：本题考查牙周炎的鉴别。患者男性，牙龈刷牙出血4年余（长期存在），进食时碰触易出血（无自发性出血），含漱后可止住（排除血液病引起）。检查：牙龈红肿。探诊深度3mm（牙龈有炎症），X线片：未见牙槽嵴顶吸收（排除牙周炎），符合慢性龈缘炎（C对）的临床表现。慢性龈缘炎是最常见的牙龈病，其病因明确且无深层牙周组织的破坏，通过洁治术清除菌斑、牙石，消除刺激牙龈的因素，炎症即可消退。慢性牙周炎（B错）患者可有刷牙或进食时的牙龈出血或口内异味，牙龈表现为鲜红或暗红色，水肿松软，并可有不同程度的肿大甚至增生。患牙探诊有＞3mm的牙周袋，并有探诊后出血，甚至溢脓。侵袭性牙周炎（E错）早期无明显症状，牙周组织破坏程度与局部刺激物的量不成比例，炎症不明显时可出现牙齿松动和移位，有严重而快速的附着丧失和牙槽骨破坏。青春期龈炎（A错）好发于前牙唇侧的龈乳头和龈缘，舌侧牙龈较少发生。唇侧牙龈肿胀较明显，龈乳头常呈球状突起，颜色暗红或鲜红，光亮，质地软，探诊出血明显。沟可加深形成龈袋，但附着水平无变化，亦无牙槽骨吸收，患者的主诉症状常为刷牙或咬硬物时出血、口臭等。坏死性龈炎（D错）起病急，病程较短，以龈乳头和龈缘的坏死为特征性损害，尤以下颌前牙多见，初起时龈乳头充血水肿，在个别龈乳头的顶端发生坏死性溃疡，上覆有灰白色污秽的坏死物，去除坏死物后可见龈乳头的颊、舌侧尚存，而中央凹下如火山口状。